半夏天麻丸的功能是
A. 解表散寒，宣肺止嗽
B. 健脾祛湿，化痰息风
C. 宣肺散寒，止咳祛痰
D. 清肺化痰，润肺止咳
E. 燥湿化痰，理气和胃

正确答案：B。健脾祛湿，化痰息风

解析：本题考查的是半夏天麻丸的功能。半夏天麻丸的功能是健脾祛湿，化痰息风（B对）。半夏天麻丸：【功能】健脾祛湿，化痰息风。杏苏止咳颗粒：【功能】宣肺散寒，止咳祛痰（C错）。蜜炼川贝枇杷膏：【功能】清热润肺，化痰止咳（D错）。二陈丸：【功能】燥湿化痰，理气和胃（E错）。功能为解表散寒，宣肺止嗽（A错）的中成药，2022年考试指南未明确说明。